木瓜丸的功能是
A. 祛风除湿，通络止痛，补益肝肾
B. 壮腰健肾，祛风活络
C. 祛风散寒，除湿通络
D. 祛风散寒，化痰除湿，活血止痛
E. 清热利湿

正确答案：C。祛风散寒，除湿通络

解析：本题考查木瓜丸的功能。木瓜丸的功能是祛风散寒，除湿通络（C对）。天麻丸（片）【功能】祛风除湿，通络止痛，补益肝肾（A错）。壮腰健肾丸（口服液）【功能】壮腰健肾，祛风活络（B错）。木瓜丸【功能】祛风散寒，除湿通络（C错）。小活络丸【功能】祛风散寒，化痰除湿，活血止痛（D错）。四妙丸【功能】清热利湿（E错）。